由原发证机关注销《药品经营许可证》的情形不包括
A. 《药品经营许可证》有效期届满未换证的
B. 药品经营企业终止经营药品或关闭的
C. 《药品经营许可证》被依法撤销、撤回、吊销、收回或缴销的
D. 不可抗力导致《药品经营许可证》的许可事项无法实施的
E. 违反药品广告规定的

正确答案：E。违反药品广告规定的

解析：本题考查的是药品经营许可证注销。由原发证机关注销《药品经营许可证》的情形不包括（E错，为本题正确答案）。药品经营许可证注销：根据《药品经营监督管理办法》的规定，药品经营企业有下列情形之一的，药品经营许可证由原发证机关注销，并予以公告：申请人主动申请注销药品经营许可证的；药品经营许可证有效期届满未申请换证的（A对）；药品经营企业终止经营药品的（B对）；药品经营许可证被依法撤销或吊销的（C对）；营业执照被依法吊销或注销的；法律、法规规定的应当注销行政许可的其他情形（D对）。